生后15天的男婴突然高热、哭闹、拒食、昏睡，腰骶部皮肤红肿并出现水疱，触之皮下空虚，有皮肤漂浮感，其原因可能是
A. 急性蜂窝织炎
B. 丹毒
C. 新生儿皮下坏疽
D. 气性坏疽
E. 深部脓肿

正确答案：C。新生儿皮下坏疽